双侧游离端缺失属于Kennedy分类的
A. 第一类
B. 第二类
C. 第三类
D. 第四类
E. 第一类一分类

正确答案：A。第一类

解析：本题考查Kennedy牙列缺损分类。双侧游离端缺失属于Kennedy分类的第一类（A对），单侧游离端缺失属于Kennedy分类的第二类（B错），单侧非游离端缺失属于Kennedy分类的第三类（C错），前牙缺失且跨过中线属于Kennedy分类的第四类（D错），即除主要缺隙外，如还有一个缺隙则为第一亚类（E错）。